既安神，又祛风的药是
A. 珍珠
B. 酸枣仁
C. 柏子仁
D. 夜交藤
E. 合欢皮

正确答案：D。夜交藤

解析：本题考查的是夜交藤的功效。既安神，又祛风的药是夜交藤（D对）。夜交藤：【功效】养心安神，祛风通络。珍珠（A错）：【功效】安神定惊，明目除翳，解毒敛疮，润肤祛斑。酸枣仁（B错）：【功效】养心安神，敛汗。柏子仁（C错）：【功效】养心安神，润肠通便，止汗。合欢皮（E错）：【功效】解郁安神，活血消肿。